血清壁细胞抗体阳性多见于哪种疾病
A. 慢性萎缩性胃体胃炎
B. 慢性萎缩性胃窦胃炎
C. 胃溃疡
D. 胃癌
E. 急性糜烂性胃炎

正确答案：A。慢性萎缩性胃体胃炎

解析：慢性萎缩性胃体胃炎（A对）为A型胃炎，多与自身免疫有关，患者体内血清壁细胞抗体阳性。慢性萎缩性胃窦胃炎（B错）为B型胃炎，多由幽门螺杆菌感染所致，少数患者可见血清壁细胞抗体阳性。胃溃疡（C错）、胃癌（D错）、急性糜烂性胃炎（E错）血清壁细胞抗体均为阴性。